长期大量服用维生素D可出现
A. 颅内压上升
B. 肢端肥大
C. 乳腺肿大
D. 尿频和腹泻
E. 肝肾损害和骨骼硬化

正确答案：E。肝肾损害和骨骼硬化

解析：本题考查维生素的不良反应。长期大量服用维生素D可出现肾脏损害、低热、肝脏肿大，骨硬化等症（E对）。长期大量服用维生素A可引起慢性中毒，出现颅内压增高（A错）、剧烈头痛等现象。大量服用维生素E可引起视物模糊、乳腺肿大（C错）等；长期超量使用维生素E可引起血压升高，出现血栓危险。服用维生素C偶见腹泻、皮肤红亮、头痛、尿频（D错）等；长期大量使用可引起泌尿系统尿酸盐、半胱氨酸盐或草酸盐结石。成年人长期使用生长激素类药物可引起肢端肥大症（B错）。